真寒假热证的产生机理是
A. 阴盛格阳
B. 阳盛格阴
C. 阳虚外寒
D. 阴虚内热
E. 寒证化热

正确答案：A。阴盛格阳

解析：真寒假热证是指疾病的本质为寒证，却出现某些“热象”的表现（A对）。阳盛格阴会发为真热假寒（B错）。阳虚外寒则会发为虚寒证（C错）。阴虚内热则会发为虚热证（D错）。寒证化热会发为热证（E错）。